下列具有驱肠虫作用的药物是
A. 左旋咪唑
B. 阿苯达唑
C. A和B均是
D. A和B均不是

正确答案：C。A和B均是

解析：本题考查抗肠蠕虫药。下列具有驱肠虫作用的药物是左旋咪唑和阿苯达唑（C对）。左旋咪唑对蛔虫、蛲虫、钩虫有明显驱虫作用。临床主要用于蛔虫病、钩虫病以及回钩虫混合感染。阿苯达唑
为广谱驱虫药，可阻断虫体对多种营养和葡萄糖的摄取，导致虫体糖原耗竭，致使寄生虫无法生存和繁殖。临床用于蛔虫病、蛲虫病和钩虫病。